初孕妇，24岁。规律宫缩12小时，羊膜囊完整，胎头S+1，胎心140次/分。对该患者的处理是
A. 立即行人工破膜
B. 无需处理
C. 立即剖宫产
D. 静滴缩宫素
E. 会阴剪切

正确答案：A。立即行人工破膜

解析：青年初孕妇，规律宫缩12小时（≥11～12小时），胎头下降至坐骨棘平面下1cm（胎头S+1），则胎头已衔接，而此时羊膜囊呈完整状态，影响胎头下降，故对该患者的处理是立即行人工破膜（A对）。无需处理（B错）则会影响胎头下降，出现胎儿窘迫。该孕妇能经阴道分娩，不采取立即剖宫产（C错）。未破膜者不宜使用静滴缩宫素（D错），可因收缩过强致胎儿窘迫，甚至子宫破裂。会阴剪切（E错）适用于胎头过大，不能顺利通过阴道口时。